某男，59岁。半年来，腰膝软，盗汗遗精，神疲口燥。证属真阴不足。治当滋肾补阴，宜选用的成药是
A. 玉泉丸
B. 左归丸
C. 薯蓣丸
D. 大补阴丸
E. 麦味地黄丸

正确答案：B。左归丸

解析：本题考查的是左归丸的功能。半年来，腰膝软，盗汗遗精，神疲口燥。证属真阴不足。治当滋肾补阴，宜选用的成药是左归丸（B对）。左归丸：【功能】滋肾补阴。玉泉丸（A错）：【功能】清热养阴，生津止渴。薯蓣丸（C错）：【功能】调理脾胃，益气和营。大补阴丸（D错）：【功能】滋阴降火。麦味地黄丸（E错）：【功能】滋肾养肺。